流行性腮腺炎临床上最常见的并发症为
A. 睾丸炎脑膜脑炎
B. 多发性神经炎
C. 病毒性肺炎
D. 病毒性心肌炎
E. 病毒性肠炎

正确答案：A。睾丸炎脑膜脑炎

解析：流行性腮腺炎临床上最常见的并发症为睾丸炎脑膜脑炎，由于病毒对腺体组织和神经组织具有高度亲和性，可使多种腺体（腮腺、舌下腺、颌下腺、胰腺、生殖腺等）发生炎症改变，如侵犯神经系统，可导致脑膜脑炎等严重病变（A对）。